咽旁间隙位于哪种肌肉与腮腺深叶和咽侧壁之间
A. 咬肌
B. 颞肌
C. 翼内肌
D. 翼外肌
E. 舌骨上肌群

正确答案：C。翼内肌

解析：咽旁间隙（咽侧间隙）位于翼内肌、腮腺深叶与咽侧壁之间。上达颅底，下至舌骨平面，前界为翼下颌韧带，后界为椎前筋膜外侧份。掌握“咀嚼肌、颈部肌及口颌系统肌链”知识点。